底蜕膜的作用是
A. 构成胎盘的胎儿部分
B. 排泄胎儿代谢产物
C. 合成激素和酶
D. 产生孕激素
E. 构成胎盘母体面

正确答案：E。构成胎盘母体面

解析：底蜕膜是囊胚着床部位的子宫内膜，其作用是构成胎盘母体面（E对）。构成胎盘的胎儿部分的是附着在胎盘的羊膜和叶状绒毛膜（A错）。排泄胎儿代谢产物（B错）、合成激素和酶（C错）及产生孕激素（D错）是胎盘的功能（P34）。